欲行全子宫加双附件切除，不需要切断的韧带是
A. 圆韧带
B. 卵巢固有韧带
C. 卵巢悬韧带
D. 阔韧带
E. 主韧带

正确答案：B。卵巢固有韧带

解析：子宫韧带共有4对，分别是圆韧带、主韧带、阔韧带及宫骶韧带，它们固定子宫于骨盆侧壁及骶椎之间。卵巢悬韧带连接卵巢外侧与盆壁之间，卵巢固有韧带连接卵巢内侧与子宫之间。行全子宫加双附件切除时，需要将子宫、卵巢与盆壁相连的韧带，即圆韧带（A错）、主韧带（E错）、阔韧带（D错）和卵巢悬韧带（C错）切断，不需要将子宫与卵巢之间的卵巢固有韧带（B对）切断。